用测定膨胀度的方法可鉴别其品种的药材是
A. 葶苈子
B. 木瓜
C. 金樱子
D. 山楂
E. 蛇床子

正确答案：A。葶苈子

解析：本题考查的是葶苈子的理化鉴别。用测定膨胀度的方法可鉴别其品种的药材是葶苈子（A对）。膨胀度测定：膨胀度是药品膨胀性质的指标，是指每1g药品在水或其他规定的溶剂中，在一定的时间与温度条件下膨胀后所占有的体积（ml）。主要用于含黏液质、胶质和半纤维素类的天然药品。《中国药典》规定，车前子膨胀度不低于4.0；哈蟆油膨胀度不低于55；南葶苈子膨胀度不低于3，北葶苈子膨胀度不低于12。